患儿流涕、咳嗽3天后，高热不退咳嗽喘促，鼻煽，喉中痰声辘辘，口唇发绀。其证候是
A. 风寒闭肺
B. 风热闭肺
C. 痰热闭肺
D. 痰热咳嗽
E. 心阳虚衰

正确答案：C。痰热闭肺

解析：患儿在流涕、咳嗽3天后出现了发热、咳嗽、痰壅、气急、鼻煽，可诊断为肺炎喘嗽之痰热闭肺。（C对）。风寒闭肺证以恶寒发热，呛咳气急，痰白而稀为特征（A错）。风热闭肺证以发热恶风，咳嗽气急，痰黄粘稠为特征（B错）。痰热咳嗽以长期、反复、逐渐加重的咳嗽及白色黏液泡沫痰为特征（D错）。心阳虚衰以突然面色苍白，四肢厥冷，肝脏迅速增大为特征（E错）。